呋塞米临床应用
A. 低血脂
B. 脑动脉硬化
C. 水肿
D. 低血糖
E. 支气管哮喘

正确答案：C。水肿

解析：本题考查呋塞米的临床作用。呋塞米临床应用于水肿（C对）。呋塞米对心、肝、肾性等各类水肿均有效。主要用于其他利尿药无效的顽固性水肿和严重水肿。脑动脉硬化（B错）治疗主要为调血脂类药物和抗血小板聚集类药物，如辛伐他汀、阿司匹林等。低血糖（D错）治疗首选5%～10%葡萄糖溶液静滴。支气管哮喘（E错）治疗首选吸入糖皮质激素。